治疗咳嗽，除以治肺为主外，还应注意治
A. 肝、脾、肾
B. 心、肝、肾
C. 心、脾、肾
D. 心、肝、脾
E. 肝、胃、肾

正确答案：A。肝、脾、肾

解析：外感咳嗽常伤及肺脏，而内伤咳嗽，常见他脏病及肺脏，多因实致虚，“如肝火犯肺者，气火炼液成痰，灼伤肺津；痰湿犯肺者，多因湿困中焦，水谷不能化为精微上输以养肺，反而聚生痰浊，上干肺脏，久延则肺脾气虚，气不化津，痰浊更易滋生；甚则病及于肾，以致肺虚不能主气，肾虚不能纳气，由咳致喘，加重病情”（A对）（BCDE错）。